局限性侵袭性牙周炎主要侵及的牙位是
A. 第一恒磨牙、第二恒磨牙
B. 第一恒磨牙、上下切牙
C. 第一恒磨牙、第一前磨牙
D. 第二恒磨牙、上下切牙
E. 第二恒磨牙、上下尖牙

正确答案：B。第一恒磨牙、上下切牙

解析：局限型侵袭性牙周炎典型的患牙局限于第一恒磨牙和上下切牙。掌握“侵袭性牙周炎”知识点。